肾病综合征有以下特点除了
A. 水肿程度与低蛋白血症程度一致
B. 水钠潴留不依赖RAAS变化
C. 常存在高凝状态
D. 不会出现急性肾功能衰竭
E. 可造成维生素D缺乏

正确答案：D。不会出现急性肾功能衰竭